能杀伤细胞的细胞因子是
A. IL-2
B. TNF-α
C. 干扰素
D. IL-4
E. IL-1

正确答案：B。TNF-α